评定食物蛋白质营养价值时，采用的参考蛋白是
A. 蛋类
B. 肉类
C. 鱼类
D. 奶类
E. 豆类

正确答案：A。蛋类